某农村医疗卫生机构因不具备集中处置医疗废物条件而未按照要求处置医疗废物，并造成传染病传播。则该机构可能受到的处罚是
A. 处5000元以上3万元以下的罚款
B. 处5000元以上1万元以下的罚款
C. 处1万以上3万元以下的罚款
D. 吊销执业许可证件
E. 依法追究刑事责任

正确答案：D。吊销执业许可证件